5岁以下儿童首选的散瞳药是
A. 10%去氧肾上腺素滴眼液
B. 1%硫酸阿托品滴眼膏
C. 2%后马托品滴眼剂
D. 四环素可的松眼膏剂
E. 3%氧氟沙星眼膏剂

正确答案：B。1%硫酸阿托品滴眼膏

解析：本题考查散瞳药。5岁以下儿童首选的散瞳药是1%硫酸阿托品滴眼膏（B对）。1%阿托品滴眼剂可引起睫状肌麻痹，适用于青少年的屈光检查，涂用眼膏剂可减少药物的全身吸收，因此1%阿托品眼膏剂更适合于5岁以下儿童。